延长动作电位时程的抗心律失常药是
A. 普萘洛尔
B. 胺碘酮
C. 奎尼丁
D. 苯妥英钠
E. 维拉帕米

正确答案：B。胺碘酮

解析：本题考查胺碘酮。胺碘酮（B对）为延长动作电位时程的药，通过阻断介导复极的钾通道而延长心脏动作电位时程，用于治疗室上性和室性心律失常。普奈洛尔（A错）是β受体阻断剂，用于治疗β受体介导的心律失常。奎尼丁（C错）和苯妥英钠（D错）均是钠通道阻断剂。维拉帕米（E错）是钙通道阻滞剂，通过抑制钙离子内流，延长窦房结和房室结有效不应期和功能不应期，减慢窦房结的自律性和房室结的传导。